下列作业中接触氰化物机会最多的是
A. 炼钢
B. 电镀
C. 塑料生产
D. 印染

正确答案：B。电镀

解析：本题考查氰化物的接触机会。在化学反应过程中，尤其在高温或与酸性物质作用时，能放出氰化氢气体。氰化物的接触主要在以下8个方面。1.电镀（B对ACD错）、采矿冶金工业；2.含氰化合物的生产；3.化学工业；4.染料工业；5.摄影；6.农业；7.军事；8.某些植物